成釉细胞瘤穿刺检查可抽出
A. 血性液体
B. 褐色液体
C. 淡黄色水样液体
D. 草绿色液体
E. 乳白色豆腐渣样

正确答案：B。褐色液体

解析：本题考查成釉细胞瘤。成釉细胞瘤大多为实质性，如囊性成分较多时，穿刺检查可抽出褐色液体（B对），可资与颌骨囊肿液多为淡黄色相区别。